执业药师资格注册管理机构是
A. 国家药品监督管理部门
B. 国家人事部
C. 国家药品监督管理部门和人事部
D. 省药品监督管理部门
E. 省人事部门

正确答案：A。国家药品监督管理部门

解析：本题考查执业药师。执业药师资格注册管理机构是国家药品监督管理部门（A对）。我国执业药师实行注册制度，国家药品监督管理局负责执业药师注册的政策制定和组织实施，指导全国执业药师注册管理工作。国家药品监督管理部门和人事部（C错）是执业药师资格考试机构。各省、自治区、直辖市药品监督管理局（D错）为注册机构。